关于运动系统慢性损伤，不正确的是
A. 生理性或结构性异常，应力均匀
B. 操作技术不熟练
C. 长期慢性损伤
D. 超越人体局部代偿
E. 急性损伤后未得到正确的康复

正确答案：A。生理性或结构性异常，应力均匀

解析：身体生理结构或姿态性异常，应力分布不均是运动系统慢性损伤的原因（A错，为本题正确答案）。